急性感染性心内膜炎最常见的致病菌是
A. 草绿色链球菌
B. 金黄色葡萄球菌
C. 淋球菌
D. 肺炎球菌
E. 肠球菌

正确答案：B。金黄色葡萄球菌

解析：急性感染性心内膜炎最常见的致病菌是金黄色葡萄球菌（B对），少数由肺炎球菌（D错）、淋球菌（C错）等所致。草绿色链球菌（A错）和肠球菌（E错）多导致亚急性感染性心内膜炎。